属于β₂受体激动剂的平喘药是
A. 茶碱
B. 沙美特罗
C. 噻托溴铵
D. 孟鲁司特
E. 布地奈德

正确答案：B。沙美特罗

解析：本题考查平喘药的分类。沙美特罗（B对）为β₂受体激动剂，用于防治支气管哮喘，包括夜间哮喘和运动引起的支气管痉挛。除沙美特罗外长效β₂受体激动剂还有福莫特罗、丙卡特罗。茶碱（A错）为磷酸二酯酶抑制剂。噻托溴铵（C错）为长效M胆碱受体阻断剂。孟鲁司特（D错）为白三烯受体阻断剂。布地奈德（E错）属于吸入型糖皮质激素。